参苓白术散的功用是
A. 渗湿
B. 通便
C. 升阳
D. 补血
E. 疏肝

正确答案：A。渗湿

解析：本题考查参苓白术散的功用，属记忆内容。参苓白术散的功用益气健脾，渗湿止泻（A对）。本方治疗脾虚湿盛中的肠鸣泄泻（B错）。升阳，补血，疏肝不是此方的功效（CDE错）。